肌红蛋白分子中主要的二维结构
A. 氢键、盐键、疏水键和二硫键
B. “S”型
C. 加热
D. 双曲线
E. α-螺旋

正确答案：E。α-螺旋

解析：存在于红色肌肉组织中的肌红蛋白（Mb），是由153个氨基酸残基构成的单链蛋白质，含有一个血红素辅基，能够进行可逆的氧合与脱氧。X射线衍射法测定了它的空间构象，多肽链中α-螺旋占75%，形成A至H的8个螺旋区，两个螺旋区之间有一段无规卷曲，脯氨酸位于拐角处。掌握“蛋白质结构与功能关系”知识点。